易诱生免疫耐受的是
A. 皮内接种抗原
B. 皮下接种抗原
C. 口服接种抗原
D. 接种颗粒性抗原
E. 接种中等量抗原

正确答案：C。口服接种抗原